诊断瘿病的重要体征是
A. 肿块的位置
B. 有无压痛
C. 有无震颤
D. 是否随吞咽上下移动
E. 有无波动感

正确答案：D。是否随吞咽上下移动

解析：瘿是甲状腺疾病的总称，甲状腺位于颈部甲状软骨下方，气管两旁，由两侧叶和峡部组成，在甲状腺侧叶与环状软骨之间常有韧带样的结缔组织相连接，故吞咽时，甲状腺可随吞咽而上下移动，所以瘿病的重要体征是是否随吞咽上下移动（D对）。并不能直接通过观看肿块的位置判断其位置是否在甲状腺（A错）。瘿病中气瘿、肉瘿无压痛，瘿痈有压痛，瘿病不全都有压痛（B错）。瘿病不全都可触及震颤，其中甲状腺功能亢进可触及震颤（C错）。在瘿病的体查中，有无波动感并不属于其检查内容之一，有无波动感多是判别脓成与否（E错）。